耳蜗
A. 位于前庭前方
B. 骨螺旋管环绕蜗轴旋转两圈半
C. 骨半规管开口于前庭前壁
D. 前、外骨半规管合成总骨脚
E. 耳蜗连于前庭后壁

正确答案：A。位于前庭前方

解析：耳蜗位于前庭的前方（A对）。耳蜗由蜗轴和蜗螺旋管构成，蜗螺旋管是由骨密质围成的骨管，围绕蜗轴盘曲约两圈半（B错）。前庭前部（E错）较窄，有一孔连通耳蜗；前庭后上壁（C错）较宽，有5 个小孔通骨半规管。前、后半规管（D错）的单骨脚合成一个总骨脚。